熟悉各种传染病潜伏期的重要意义在于
A. 有助于传染病诊断
B. 估计传染病严重性
C. 预测疫情
D. 确定医学观察期限
E. 推测疾病预后

正确答案：D。确定医学观察期限

解析：本题考查潜伏期的流行病学意义。潜伏期的流行病学意义为：①根据潜伏期的长短判断病人受感染的时间；②根据潜伏期的长短确定接触者的留验、检疫和医学观察期限（D对ABCE错）；③根据潜伏期的长短确定免疫接种的时间；④根据潜伏期来评价防制措施的效果；⑤潜伏期的长短会影响疾病的流行特征。